杂质检查所用的试剂为：酸度的检查
A. 稀盐酸
B. 锌粒
C. 稀硫酸
D. 甲基红指示液
E. 醋酸盐缓冲液（pH3.5）

正确答案：D。甲基红指示液